《素问•阴阳应象大论》提出调整阴阳，其“中满者”，应
A. 因而越之
B. 引而竭之
C. 泻之于内
D. 按而收之
E. 散而泻之

正确答案：C。泻之于内

解析：本题考查防治原则中的调整阴阳，同时也是对经典原文的考查。属于记忆内容。《素问•阴阳应象大论》所说：“其高者，因而越之（A错）；其下者，引而竭之（B错）；中满者，泻之于内（C对）；其有邪者，渍形以为汗；其在皮者，汗而发之；其慄悍者，按而收之（D错）；其实者，散而泻之（E错）”。